对放射线中等敏感的肿瘤是
A. 恶性黑色素瘤
B. 脂肪肉瘤
C. 基底细胞癌
D. 浆细胞肉瘤
E. 恶性淋巴瘤

正确答案：C。基底细胞癌

解析：对放射线敏感的肿瘤有：恶性淋巴瘤、浆细胞肉瘤、未分化癌、淋巴上皮癌、尤文（Ewing）肉瘤。对放射线中度敏感的肿瘤有：鳞状细胞癌、基底细胞癌。对放射线不敏感的肿瘤有：骨肉瘤、纤维肉瘤、肌肉瘤、腺癌、脂肪肉瘤、恶性黑色素瘤等。掌握“口腔颌面部肿瘤的治疗原则及预防”知识点。